根管横断面可呈C字形的牙齿为
A. 上颌第一磨牙
B. 上颌第二磨牙
C. 上颌第三磨牙
D. 下颌第一磨牙
E. 下颌第二磨牙

正确答案：E。下颌第二磨牙

解析：下颌第二磨牙根管的颊舌径很宽，有的近中根只有1个较扁的根管，也有一些第二磨牙近远中根管在颊侧融合，横断面呈1个C形单根管。掌握“恒磨牙髓腔形态及乳恒牙髓腔临床意义”知识点。